下列有关模型观测的目的，说法不正确的是
A. 确定义齿就位道
B. 确定软硬组织倒凹
C. 确定牙尖交错（牙合）
D. 辅助制订修复治疗计划
E. 确定余留牙导平面的位置

正确答案：C。确定牙尖交错（牙合）

解析：模型观测的目的：（1）选择并确定义齿就位道。（2）确定余留牙导平面的位置。（3）确定软硬组织倒凹。（4）辅助制订修复治疗计划。掌握“局部义齿类型，肯氏分类及模型观测”知识点。